男性，19岁，无业青年，父亲是生意人，该青年5年来一直在购买收藏女性的高跟鞋而感到满足，而且晚上要抱着高跟鞋睡觉，在心理咨询门诊诊断为“恋物癖”，对此类患者的治疗方法最好选择
A. 人本主义
B. 厌恶治疗
C. 自由联想
D. 系统脱敏
E. 梦的分析

正确答案：B。厌恶治疗

解析：此题患者诊断为恋物癖。厌恶疗法是指，当某种适应不良行为即将出现或正在出现时，当即给予一定的痛苦刺激，使其产生厌恶的主观体验。经过反复实施，适应不良行为和厌恶体验就建立了一定的条件联系，以后为了避免这种厌恶体验，患者只有终止或放弃原有的适应不良行为。厌恶疗法主要适用于露阴癖、恋物癖（B对）、酒精依赖及强迫症等。人本主义疗法主要适用于治疗有某种心理问题的正常人或轻度心理障碍患者，如人际关系问题、个人成长问题、社会适应不良、某些神经症患者（A错）。自由联想和梦的分析都属于经典精神分析疗法，主要用于治疗各种神经症、心境障碍、某些人格障碍等（CE错）。系统脱敏疗法主要用于治疗恐怖症，也可用于治疗癔症（D错）。